以下情形中不予医师执业注册的是
A. 受过刑事处罚的
B. 受刑事处罚，自刑罚执行完毕之日起至申请注册之日止不满3年的
C. 不具有完全民事行为能力的
D. 受过吊销医师执业证书行政处罚的
E. 受吊销医师执业证书行政处罚，自处罚之日起至申请注册之日止不满3年的

正确答案：C。不具有完全民事行为能力的